蛔虫病的治疗方法主要是
A. 散结止痛
B. 暖腹安蛔
C. 驱蛔杀虫
D. 安蛔止痛
E. 通腹驱蛔

正确答案：C。驱蛔杀虫

解析：蛔虫病总的治疗原则为驱蛔杀虫，调理脾胃（C对）。出现蛔厥证时先安蛔定痛，继以驱蛔杀虫（D错）。虫瘕证宜通腑散结，驱蛔下虫（ABE错）。